关于硬脑膜的描述，何者是正确的
A. 硬脑膜与颅底骨之间容易分开
B. 颅部硬膜外血肿发生在硬膜外隙内
C. 脑和脊髓的硬膜外隙互通
D. 硬脑膜的内外两层伸入两大脑半球之间形成大脑镰
E. 无

正确答案：B。颅部硬膜外血肿发生在硬膜外隙内

解析：硬脑膜在颅底处硬脑膜则与颅骨结合紧密，因此，硬脑膜与颅底骨之间不易分开（A错），当硬脑膜血管损伤时，可在硬脑膜与颅骨之间，即颅部硬膜外血肿发生在硬膜外隙内（B对），硬脑膜在脑神经出颅处移行为神经外膜，硬脑膜内层在枕骨大孔的边缘与硬脊膜相延续，因此脑和脊髓的硬膜外隙并不互通（C错），硬脑膜内层可折叠形成若干板状突起伸入两大脑半球之间形成大脑镰（D错）。